在血浆样品制备中，常用的抗凝剂是
A. 肝素
B. 氯化钠
C. 葡萄糖
D. 三氯醋酸
E. 氢氧化钠

正确答案：A。肝素

解析：本题考查体内药物检测。血浆样品制备中常用的抗凝剂：1、非肠道用药的抗凝剂，如肝素；2、香豆素抗凝剂类，如华法林；3、抗血小板聚集药物，如阿司匹林；4、新型抗凝药，如阿加曲班。氯化钠（B错）可作为药物溶解剂进行补液。葡萄糖（C错）用于供能。三氯醋酸（D错）可以治疗尖锐湿疣。氢氧化钠（E错）是强碱，可以用来调节pH。